生理性根尖孔通常距解剖根尖约
A. 0.5～1mm
B. 1～3mm
C. 3～4mm
D. 4～5mm
E. 5～6mm

正确答案：A。0.5～1mm

解析：根管治疗的操作止点应位于牙本质牙骨质界，通常距解剖根尖约0.5～1mm。牙本质牙骨质界是根管最狭窄处，是牙髓与牙周组织的分界，又被称为组织学根尖孔或生理性根尖孔。掌握“根尖周病概述”知识点。